既能活血定痛，又能敛疮生肌的药物是
A. 三七
B. 茜草
C. 红花
D. 血竭
E. 桃仁

正确答案：D。血竭

解析：该题考查血竭的功效。三七和茜草为化瘀止血药，无敛疮生肌的功效。血竭为活血疗伤药，味甘、咸，性平，归肝经，其功效为活血定痛，化瘀止血，敛疮生肌。红花与桃仁为活血调经药，无敛疮生肌的功效（D对）。